属于铂类化合物的抗肿瘤药是
A. 多柔比星
B. 拓扑替康
C. 甲氨蝶呤
D. 雷帕霉素
E. 奥沙利铂

正确答案：E。奥沙利铂

解析：本题考查抗肿瘤药。属于铂类化合物的抗肿瘤药是奥沙利铂（E对）。破坏DNA的铂类化合物包括：顺铂、卡铂、奥沙利铂、奈达铂等。多柔比星（A错）属蒽环类抗肿瘤抗生素。拓扑替康（B错）属喜树碱类抗肿瘤药。甲氨蝶呤（C错）属抗代谢物抗肿瘤药。雷帕霉素（D错）属大环内酯类免疫抑制剂。